下列脊髓上行纤维束中，属于一般感觉纤维束的是
A. 脊髓小脑前束
B. 脊髓小脑后束
C. 薄束
D. 楔小脑束
E. 脊髓丘脑侧束

正确答案：C。薄束

解析：一般感觉纤维指的是躯干和四肢意识性本体感觉的精细触觉。该传导通路由3级神经元组成，其中第2级神经元的胞体在薄、楔束核内，上行形成薄束和楔束。所以薄束（C对）属于一般感觉纤维。